颅前窝骨折最易损伤的脑神经是
A. 面神经
B. 嗅神经
C. 视神经
D. 听神经
E. 动眼神经

正确答案：B。嗅神经

解析：颅前窝骨折常伴嗅神经损伤（B对）。颞骨岩部骨折常发生面神经（A错）和听神经损伤（D错）。如颅中窝骨折位于中线处，可累及视神经（C错）、动眼神经（E错）。